平衡（牙合）是指
A. 正中（牙合）时有上下牙广泛均匀的接触
B. 前伸（牙合）时，前后牙均有接触
C. 侧方（牙合）时，工作侧和非工作侧均有接触
D. 非正中（牙合）时，前后和两侧牙均有接触
E. 正中（牙合）和非正中（牙合）时，上下颌相关牙都能同时接触

正确答案：E。正中（牙合）和非正中（牙合）时，上下颌相关牙都能同时接触

解析：本题考查平衡（牙合）。全口义齿平衡（牙合）指在正中（牙合）（A错）及下颌作前伸（牙合）（B错）、侧方（牙合）（D错）等非正中（牙合）（D错）时，上下颌相关的牙都能有接触，以保证义齿在功能时的固位和稳定（E对）。